患者，男，右下颌下区肿物3个月，检查见右下颌下区表面皮肤正常，触诊柔软，与皮肤无粘连，无压痛，低头时肿物稍有增大，口内检查亦未见异常。手术中见囊腔内流出蛋清样黏稠液体。术前对诊断最有意义的检查是
A. B超
B. MRI
C. CT
D. 舌下腺造影
E. 穿刺检查

正确答案：E。穿刺检查

解析：舌下腺囊肿穿刺可抽出蛋清样黏稠液体。掌握“舌下腺及唾液腺黏液囊肿”知识点。